患者小便不利，发热，口渴欲饮，心烦不寐，证属水热互结，治疗应首选
A. 五苓散
B. 猪苓汤
C. 小蓟饮子
D. 八正散
E. 导赤散

正确答案：B。猪苓汤

解析：猪苓汤方中含有猪苓、茯苓、泽泻、阿胶、滑石，具有利水，养阴，清热之功效，主治水热互结伤阴证。发热，口渴欲饮，小便不利，或心烦不寐，或咳嗽，或呕恶，或下利，舌红苔白或微黄脉细数。亦治热淋、血淋等（B对）。方中以猪苓为君，取其归肾、膀胱经，专以淡渗利水。臣以泽泻、茯苓之甘淡，益猪苓利水渗湿之力，且泽泻性寒兼可泄热，茯苓尚可健脾以助运湿。佐入滑石之甘寒，利水、清热两彰其功；阿胶滋阴润燥，既益已伤之阴，又防诸药渗利重伤阴血。五苓散主治蓄水证，痰饮，水湿内停证（A错）。小蓟饮子主治热结下焦之血淋、尿血。尿中带血，小便频数，赤涩热痛（C错）。八正散主治热淋。尿频尿急，溺时涩痛，淋沥不畅，尿色浑赤，甚则癃闭不通，小腹急满，口燥咽干，舌苔黄腻，脉滑数（D错）。导赤散主治心经火热证。心胸烦热，口渴面赤，意欲冷饮，以及口舌生疮；或心热移于小肠，小便赤涩刺痛，舌红，脉数（E错）。